依照《药品生产质量管理规范（1998年修订）》，《药品生产质量管理规范》是药品生产和质量管理的
A. 关键工序
B. 自律性规范
C. 最后工序
D. 全过程
E. 基本准则

正确答案：E。基本准则